右心房有
A. 肺静脉口
B. 肺动脉口
C. 上腔静脉口
D. 右房室瓣
E. 动脉圆锥

正确答案：C。上腔静脉口

解析：冠状窦口、下腔静脉口和上腔静脉口（C对）均位于右心房内。